在铁减少期，出现改变的指标是
A. 血红蛋白下降
B. 血清铁下降
C. 血清铁蛋白下降
D. 运铁蛋白浓度下降
E. 血细胞比容下降

正确答案：C。血清铁蛋白下降